脾
A. 腋血管周围
B. 上缘有2-3个脾切迹
C. 长轴与肋弓相一致
D. 大部分附着于甲状腺
E. 属腹膜间位器官

正确答案：B。上缘有2-3个脾切迹

解析：脾上缘有2~3个脾切迹（B对），是脾肿大时触诊的标志。